下述何项不属乙型病毒性肝炎母婴传播途径
A. 粪-口传染
B. 娩出时接触母亲产道分泌液或血污染
C. 母婴垂直传染
D. 乳汁传染
E. 胎盘屏障受损母血渗漏

正确答案：A。粪-口传染